可以作为致畸试验阳性对照物的是
A. 维生素E，敌枯双，五氯酚钠
B. 维生素D，敌枯双，五氯酚钠
C. 维生素C，敌枯双，五氯酚钠
D. 维生素A，敌枯双，五氯酚钠
E. B族维生素，敌枯双，五氯酚钠

正确答案：D。维生素A，敌枯双，五氯酚钠